X线表现为食管受压向后移位的是
A. 左心房增大
B. 右心房增大
C. 左心室增大
D. 右心室增大
E. 心包积液

正确答案：A。左心房增大

解析：左心房增大可见：①食管受压向后移位。②心右缘双弧影，心底部双心房影。③心左缘可见左心耳突出（第三弓）。④左主支气管受压抬高。左心房增大常见于二尖瓣病变、左心衰竭和一些先天性心脏病，如动脉导管未闭等（A对）。右心房增大可见：①LAO示右心房段延长超过心前缘长度一半以上，膨隆，并与心室段成角。②PA示心右缘向右扩展、膨隆，显著增大时弧度加长，最突出点位置较高，常有上腔静脉扩张（B错）。左心室增大左侧位示心后间隙变窄甚至消失，心后食管前间隙消失（C错）。右心室增大可见右心室段前缘呈弧形前突，心前间隙变窄（D错）。心包积液，当大量积液的X线征象为心影向两侧扩张，呈普遍增大型或球形，心腰及心缘各弓的正常分界消失，心膈角变钝；心缘搏动普遍减弱甚至消失，主动脉搏动可正常；短期内心影大小可有明显的变化（E错）。